与利福平描述不符的是
A. 为半合成抗生素
B. 易被亚硝酸氧化
C. 对第八对脑神经有显著的损害
D. 与异烟肼、乙胺丁醇合用有协同作用
E. 遇光易变质

正确答案：C。对第八对脑神经有显著的损害